能耗竭递质，导致骨骼肌神经-肌接头处传递效应降低的物质是
A. α-银环蛇毒
B. 新斯的明
C. 筒箭毒碱
D. 黑寡妇蜘蛛毒
E. 有机磷农药

正确答案：D。黑寡妇蜘蛛毒

解析：能耗竭递质，导致骨骼肌神经-肌接头处传递效应降低的物质是黑寡妇蜘蛛毒（D对）。α-银环蛇毒（A错）和筒箭毒碱（C错）可与终板膜上N受体结合，与乙酰胆碱竞争结合位点，从而导致传递受阻。新斯的明（B错）和有机磷农药（E错）通过抑制AChE活性而发挥拟胆碱作用，前者有较强的兴奋骨骼肌作用（P60）；后者与AChE以共价键结合，形成难以水解的磷酰化AChE，临床表现多样化（P61）。